左肺根内主要结构由上向下的排列关系依次为
A. 肺静脉、肺动脉、支气管
B. 肺静脉、支气管、肺动脉
C. 肺动脉、肺静脉、支气管
D. 肺动脉、支气管、肺静脉
E. 无

正确答案：D。肺动脉、支气管、肺静脉

解析：左肺根内主要结构由上向下的排列关系依次为肺动脉、支气管、肺静脉（D对）。